牙面清洁后到新的牙菌斑成熟，可被菌斑显示剂着色大约的时间
A. 2小时
B. 9小时
C. 12小时
D. 2天
E. 12天

正确答案：C。12小时

解析：早期菌斑增长较快，成熟时较慢，一般12小时的菌斑便可被菌斑显示剂着色，9天后便形成各种细菌的复杂生态群体，约10～30天的菌斑成熟达到高峰。掌握“牙周炎病因学”知识点。